下列各项，不属亚急性重型肝炎并发症的是
A. 脑水肿
B. 消化道出血
C. 血糖增高
D. 电解质紊乱
E. 严重感染

正确答案：C。血糖增高

解析：亚急性重型肝炎晚期可有难治性并发症，如脑水肿（A对）、消化道大出血（B对）、严重感染（E对）、电解质紊乱（D对）及酸碱平衡失调、白细胞升高、血红蛋白下降、低血糖、低胆固醇、低胆碱酯酶（C错，为本题正确答案）。